我国实行的献血制度是
A. 光荣献血制度
B. 义务献血制度
C. 强制献血制度
D. 无偿献血制度
E. 自愿献血制度

正确答案：D。无偿献血制度

解析：我国实行无偿献血制度（D对）。